女，36岁，确诊肾病综合征，血白蛋白15g/L。近两日感右侧腰部隐痛，尿色偏深，无明显尿频尿急尿痛。尿常规：RBC20～40/HP，WBC0～2/HP，B超：双肾输尿管未见异常。应首先考虑的合并症是
A. 急性肾盂肾炎
B. 隐匿性肾炎
C. 肾结核
D. 肾静脉血栓形成
E. 肾肿瘤

正确答案：D。肾静脉血栓形成

解析：肾病综合征由于血液浓缩及高脂血症造成血液粘稠度增加，血液呈高凝状态，尤其血白蛋白＜20g/L时，更易发生血栓、栓塞并发症，其中以肾静脉血栓最为常见，常表现为突发腰痛、血尿、尿蛋白增加和肾功能减退。结合病史和临床表现，本例应首先考虑的合并症是肾静脉血栓形成（D对）。急性肾盂肾炎（A错）常表现为发热、尿频、尿急、尿痛、排尿困难、下腹部疼痛、腰痛、肾区叩击痛、尿白细胞管型等（P493）。隐匿性肾炎（B错）仅表现为肾小球源性血尿或（和）蛋白尿，无其他任何症状（P477）。肾结核（C错）常表现为尿频、尿急、尿痛等慢性膀胱刺激症状，可有低热、盗汗等。肾肿瘤（E错）常表现为无痛性血尿。